咽部嫩红，肿痛不明显多为
A. 肺胃热毒壅盛所致
B. 肾水亏少、阴虚火旺所致
C. 痰湿凝聚所致
D. 气滞血瘀所致
E. 气血亏虚所致

正确答案：B。肾水亏少、阴虚火旺所致

解析：肾阴亏虚、虚火上炎，会出现咽部嫩红，肿痛不甚（B对）。肺胃热毒壅盛所致（A错）者多表现为咽部深红，肿痛较甚。痰湿凝聚所致（C错）者多表现为咽部淡红漫肿，疼痛轻微。气滞血瘀所致（D错）者可见于乳蛾。气血亏虚所致（E错）者多表现为咽部溃腐日久，周围淡红或苍白。